夜间睡眠发作，心电图心梗表现，自行缓解后，心电图无异常，该患者心绞痛的类型
A. 恶化型
B. 稳定型
C. 初发型
D. 静息型
E. 变异型

正确答案：E。变异型

解析：夜间睡眠发作（变异型心绞痛特点），心电图心梗表现（ST段抬高），自行缓解后，心电图无异常，考虑为变异型心绞痛（E对）。恶化型（A错）心绞痛的频率、程度、时限、诱发因素经常变动，呈进行性恶化。稳定型（B错）发作常由体力劳动或情绪激动（如愤怒、焦急、过度兴奋等）所激发。初发型（C错）通常在首发症状1~2个月内、很轻的体力活动可诱发。静息型（D错）发作于休息时，持续时间通常>20分钟。